手三阳经在躯干部的分布是
A. 肩胛部
B. 体侧
C. 胸部
D. 腹部
E. 背部

正确答案：A。肩胛部

解析：十二经脉在躯干部的分布规律：①手三阴经均从胸部行至腋下；手三阳经行于肩和肩胛部（A对）。②足三阳经自上而下走行，则阳明经行于前（胸腹面），太阳经行于后（背腰面）（E错），少阳经行于躯体两侧（B错）。足三阴经自下而上均行于腹胸面。③十二经脉在腹胸部的分布规律，自内向外依次为足少阴肾经、足阳明胃经、足太阴脾经和足厥阴肝经（CD错）。